关于支原体的生物学性状，下述哪项是错误的
A. 能通过滤菌器
B. 有独特的生活周期
C. 无细胞壁
D. 多形态性
E. 可用人工培养基培养

正确答案：B。有独特的生活周期

解析：本题考查支原体的生物学性状。有独特的生活周期（B错，为本题的正确答案）可见于衣原体。支原体是一类无细胞壁（C对）、呈高度多形态性（D对）、能通过滤菌器（A对）、可用人工培养基培养（E对）的最小原核细胞型微生物。